患儿，3岁，高热、头痛、呕吐，全身皮肤散在瘀点，脑膜刺激征阳性，烦躁不安。实验室检查：血白细胞升高，脑脊液呈化脓性改变。最可能的诊断是
A. 结核性脑膜炎
B. 流行性脑脊髓膜炎
C. 流行性乙型脑炎
D. 伤寒
E. 中毒性细菌性痢疾

正确答案：B。流行性脑脊髓膜炎

解析：流行性脑脊髓膜炎临床表现为突发高热、剧烈头痛、频繁呕吐、皮肤黏膜瘀点及脑膜刺激征，脑脊液呈化脓性改变。患儿高热、头痛、呕吐，全身皮肤散在瘀点，脑膜刺激征阳性，烦躁不安等症状符合流行性脑脊髓膜炎的临床表现；血白细胞升高，脑脊液呈化脓性改变符合化脓性脑膜炎表现，故最可能的诊断是流行性脑脊髓膜炎（B对）。结核性脑膜炎（A错）常有结核病史，常缓慢起病、低热、头痛、呕吐等，病程长，以脑膜刺激征为主，脑实质损害多在起病两周出现，颈项强直亦明显。脑脊液涂片、培养检出结核杆菌可确诊。流行性乙型脑炎（C错）外周血白细胞增高不显著，脑脊液呈无菌性脑膜炎改变，涂片及培养无细菌生长。伤寒（D错）临床特征为持续性发热、表情淡漠、相对缓脉、玫瑰疹、肝脾肿大及白细胞减少等，本例患者临床表现与之不符，无相对缓脉、玫瑰疹、白细胞计数减少等伤寒的典型表现。中毒性细菌性痢疾（E错）起病急，全身感染中毒症状较重，有高热，腹痛，腹泻，黏液脓血便，伴明显里急后重；腹痛在下腹或左下腹，左下腹明显压痛，粪检有较多白细胞、脓细胞、吞噬细胞，粪便培养可见志贺菌。